患者，女，55岁。2小时前上楼时突发胸骨后疼痛，伴汗出，经休息及含服硝酸甘油片不能缓解，既往无此病史。为确诊，应作的检查是
A. 心脏核素扫描
B. 心电图
C. 超声心动图
D. 心电向量
E. CPK

正确答案：B。心电图

解析：心肌梗死典型的心电图有特征性改变，呈动态演变过程，并有定位意义，有助于估计病情演变和预后，故可作心电图（B对）以确诊。心脏核素扫描（A错）适用于慢性、陈旧性心肌梗死的诊断。超声心动图（C错）有助于了解心室壁的运动和左心室功能，协助诊断室壁瘤和乳头肌功能失调。心电向量（D错）一般在心电图诊断可疑或不明确时均可行心电向量图检查。CPK（E错）为心肌梗死的特异性指标。